拔除残根属于
A. 龋病一级预防
B. 龋病二级预防
C. 龋病三级预防
D. 以上都不是
E. 属于治疗，不是预防

正确答案：C。龋病三级预防

解析：龋病的三级预防：①防止龋病的并发症：对龋病引起的牙髓炎、根尖周炎应进行恰当治疗，防止炎症继续发展。对不能保留的牙应及时拔除。②恢复功能：对牙体缺损及牙列缺失，及时修复，恢复口腔正常功能，保持身体健康。掌握“龋病三级预防”知识点。